胃癌主要起源于
A. 主细胞
B. 幽门腺上皮细胞
C. 腺颈部干细胞
D. 壁细胞和主细胞
E. 间质原始干细胞

正确答案：C。腺颈部干细胞

解析：胃癌主要起源于：胃腺颈部（C对）和胃小凹底部的组织干细胞。